治疗流行性脑脊髓膜炎，应首选
A. 青霉素
B. 阿奇霉素
C. 氯霉素
D. 环丙沙星
E. 复方新诺明

正确答案：A。青霉素

解析：流行性脑脊髓膜炎的致病菌为脑膜炎球菌，属于革兰氏阴性球菌，对青霉素敏感。青霉素对脑膜炎球菌有杀菌作用，虽然不易透过血脑屏障，脑脊液中药物浓度为血浓度的10%～30%，但注射大剂量能使脑脊液达到有效药物浓度而获满意疗效，治疗流行性脑脊髓膜炎，应首选青霉素（A对）。阿奇霉素（B错）为第二代大环内酯类药物，主要用于治疗呼吸道及生殖道感染。氯霉素（C错）属抑菌性广谱抗生素，是治疗伤寒、副伤寒的首选药，为治疗厌氧菌感染的特殊药物之一，其次可用于敏感微生物所致的各种感染性疾病的治疗，由于对造血系统有不良反应严重，现已少用。环丙沙星（D错）为合成的第三代喹诺酮类药物，具广谱抗菌活性，杀菌效果好，对肠杆菌、绿脓杆菌、流感嗜血杆菌、淋球菌、链球菌、军团菌、金黄色葡萄球菌具有抗菌作用，常用于治疗尿路感染、肠道感染、淋病等。复方新诺明（E错）为磺胺类抗菌药，对大肠埃希菌、流感嗜血杆菌、金黄色葡萄球菌抗菌作用明显，常用于敏感菌所致的尿路感染、急性中耳炎、肠道感染，为治疗卡氏肺孢子虫肺炎的首选药物。